机体可以降低外源性毒物毒性的反应是
A. 肝生物转化
B. 肌糖原磷酸化
C. 三羧酸循环
D. 乳酸循环
E. 甘油三酯分解

正确答案：A。肝生物转化